在非处方药中甲苯咪唑的适应证是
A. 胃酸过多、烧心
B. 关节痛、神经痛
C. 手足癣、体癣、股癣、头癣
D. 蛔虫病、蛲虫病
E. 无痰干咳、频繁剧烈的咳嗽

正确答案：D。蛔虫病、蛲虫病

解析：本题考查甲苯咪唑的适应证。在非处方药中甲苯咪唑的适应证是蛔虫病、蛲虫病（D对）。甲苯咪唑是广谱驱肠蠕虫药，对蛔虫、钩虫、蛲虫、鞭虫、绦虫的成虫及幼虫均有较好疗效，除对蛔虫及鞭虫的虫卵有杀灭作用外，还可抑制虫体摄取葡萄糖，抑制虫体生长或繁殖，使其死亡。甲苯咪唑可影响虫体多种生化代谢途径，与虫体β-微管蛋白结合而抑制微管聚集。对寄生虫的β-微管蛋白的亲和力远高于哺乳动物，选择性地使线虫的体被和肠细胞中的微管消失，是其对虫体具有选择性毒性的原因。抑制虫体线粒体延胡索酸还原酶的活性，抑制葡萄糖的转运，并使氧化磷酸化脱耦联，减少ATP生成，妨碍虫体生长发育，抑制虫体生存及繁殖而死亡。